以下哪项与奥美拉唑属于同类抗消化性溃疡药
A. 埃索美拉唑
B. 兰索拉唑
C. 雷贝拉唑
D. 泮托拉唑
E. 以上均包括

正确答案：E。以上均包括

解析：抗消化性溃疡药除了奥美拉唑，常用的还用埃索美拉唑、兰索拉唑、雷贝拉唑和泮托拉唑等。掌握“奥美拉唑”知识点。